带相反电荷的高分子材料相互交联且与囊心物凝聚成囊的方法是
A. 复凝聚法
B. 喷雾冻凝法
C. 单凝聚法
D. 液中干燥法
E. 多孔离心法

正确答案：A。复凝聚法

解析：本题考查复凝聚法的定义。复凝聚法（A对）是指带相反电荷的高分子材料相互交联且与囊心物凝聚成囊的方法。